某男，17岁，暑湿季节，突发泄泻腹痛，变黄而黏，肛门灼热，舌质红，苔黄薄腻，脉滑数。葛根岑连丸除治上述湿热蕴结之泄泻外，又治
A. 时疫感冒
B. 体虚感冒
C. 风寒感冒
D. 风热感冒
E. 风寒夹湿感冒

正确答案：D。风热感冒

解析：本题考查的是葛根芩连丸的主治。葛根岑连丸除治上述湿热蕴结之泄泻外，又治风热感冒（D对）。葛根芩连丸：【主治】湿热蕴结所致的泄泻腹痛、便黄而黏、肛门灼热；以及风热感冒所致的发热恶风、头痛身痛。参苏丸：【主治】身体虚弱，感受风寒所致的感冒（B错），症见恶寒发热、头痛鼻塞、咳嗽痰多、胸闷呕逆、乏力气短。感冒清热颗粒：【主治】风寒感冒（C错），头痛发热，恶寒身痛，鼻流清涕，咳嗽咽干。九味羌活丸：【主治】外感风寒夹湿所致的感冒（E错），症见恶寒、发热、无汗、头重而痛、肢体酸痛。主治为时疫感冒（A错）的中成药，2022年考试指南未明确说明。